下列哪项不属于目标人群对健康教育与健康促进项目执行情况满意度的评估内容
A. 培训内容是否符合自己的需要
B. 对未来活动的建议
C. 服务价格是否可以接受
D. 服务设施价格的满意度
E. 与其他参与者相处的满意度

正确答案：D。服务设施价格的满意度